错误的是
A. 黄韧带连结在相邻椎弓板之间
B. 前纵韧带防止脊柱过伸
C. 前纵韧带防止脊柱过屈
D. 后纵韧带附着于椎体与椎间盘的后面
E. 连接胸、腰、骶椎各棘突尖之间的韧带称棘上韧带

正确答案：C。前纵韧带防止脊柱过屈

解析：黄韧带是连接相邻两椎弓板间（A对）的韧带，可以限制脊柱过度前屈。前纵韧带位于椎体前面，牢固的附着于锥体和椎间盘，有防止脊柱过伸（B对C错，C为本题正确答案）的作用。后纵韧带附着于椎间盘和椎体的后面（D对），有限制脊柱过屈的作用。棘上韧带连结胸、腰、骶椎各棘突之间（E对），也有限制脊柱过度前屈的作用。